某男，30岁。高热后大便秘结，兼见口渴咽干，口唇干裂，舌红少津，宜选用的成药是
A. 舟车丸
B. 增液口服液
C. 当归龙荟丸
D. 九制大黄丸
E. 通便灵胶囊

正确答案：B。增液口服液

解析：本题考查的是增液口服液的主治。高热后大便秘结，兼见口渴咽干，口唇干裂，舌红少津，宜选用的成药是增液口服液（B对）。增液口服液：【主治】高热后，阴津亏损所致的便秘，症见大便秘结，兼见口渴咽干、口唇干燥、小便短赤、舌红少津。舟车丸（A错）：【主治】水停气滞所致的水肿，症见蓄水腹胀、四肢浮肿、胸腹胀满、停饮喘急、大便秘结、小便短少。当归龙荟丸（C错）：【主治】肝胆火旺所致的心烦不宁、头晕目眩、耳鸣耳聋、胁肋疼痛、脘腹胀痛、大便秘结。九制大黄丸（D错）：【主治】胃肠积滞所致的便秘、湿热下痢、口渴不休、停食停水、胸热心烦、小便赤黄。通便灵胶囊（E错）：【主治】热结便秘，长期卧床便秘，一时性腹胀便秘，老年习惯性便秘。